用于寻找主要污染源和主要污染物常用的评价指标是
A. 单要素环境质量指数
B. 超标指数
C. 污染物排出量
D. 排毒系数
E. 环境污染指数

正确答案：D。排毒系数